治疗排卵性功血子宫内膜不规则脱落湿热蕴结证，应首选
A. 清肝止淋汤
B. 四妙丸
C. 清经散
D. 两地汤
E. 固经丸

正确答案：E。固经丸

解析：功能失调性子宫出血是指由调节生殖的神经内分泌机制失常引起的异常子宫出血，简称功血，通常分为排卵性和无排卵性两类，排卵性功血子宫内膜不规则脱落症湿热蕴结证的病机是湿热内蕴，热扰冲任子宫；治宜清热利湿，止血调经，方选滋阴清热，固经止血的固经丸（E对）。清肝止淋汤（A错）用于排卵期出血湿热证；清经散（C错）用于排卵性黄体功能不足阳盛血热证；两地汤（D错）适用于排卵性黄体功能不足阴虚血热证；四妙丸（B错）用于湿热下注所致的痹病，症见足膝红肿，筋骨疼痛。